下列不属于牙体慢性损伤的是
A. 磨损
B. 楔状缺损
C. 酸蚀症
D. 冠折
E. 牙隐裂

正确答案：D。冠折

解析：本题考查牙体慢性损伤。冠折是由牙外伤引起的牙体组织急性损伤（D错，为本题的正确答案）。牙齿慢性损伤指牙齿在外力或化学因素作用下发生的牙体硬组织缓慢消耗损伤，常见的牙齿慢性损伤包括磨损（A对）、楔状缺损（B对）、酸蚀症（C对）、牙隐裂（E对）、牙根纵裂。